皮肤变厚，干燥，脱屑，作痒，很少糜烂流水者，其痒的原因是
A. 血虚
B. 虫淫
C. 热胜
D. 湿胜
E. 风胜

正确答案：A。血虚

解析：中医认为‘热微则痒’，即痒是因风、湿、热、虫之邪客于皮肤肌表，引起皮肉间气血不和，郁而生微热所致，或由于血虚生风燥阻于皮肤，肌肤失于濡养，内生虚热而发。皮肤变厚、干燥、脱屑，很少糜烂流水，是血虚作痒的临床表现（A对）。浸淫蔓延，黄水频流，状如虫行皮中，其痒尤甚，最易传染，是虫淫作痒的临床表现（B错）。皮疹瘾疹，焮红灼热作痒，或只发于裸露部位，或遍布全身，甚至糜烂流滋水淋漓，结痂成片，常不传染，是热胜作痒的临床表现（C错）。浸淫四窜，黄水淋漓，最易沿表皮蚀烂，越腐越痒，是湿盛作痒的临床表现（D错）。走窜无定，遍体作痒，抓破血溢，随破随收不致化腐，多为干性，是风胜作痒的临床表现（E错）。